甲型肝炎病程中，传染性最强的阶段是
A. 潜伏期
B. 黄疸前期
C. 黄疸期
D. 恢复期
E. 慢性期

正确答案：B。黄疸前期

解析：本题考查甲型肝炎病程中传染性最强的阶段。甲型肝炎病程中，传染性最强的阶段是黄疸前期（B对），甲型肝炎在潜伏末期和黄疸前期，粪便中已排出很多甲肝病毒，在潜伏末期至出现发热症状的10天内排出的病毒最多，是传染性最强的日子，出现黄疸后，排出的病毒开始减少,到黄疸出现后20天，不再排出病毒。黄疸的深浅，转氨酶的高低，与疾病的轻重程度成正比，而并不表明传染性的强与弱。